女，17岁。疲乏无力，心烦易怒，怕热多汗半年。易饿，体重下降11kg。月经量减少，经期仅1～2天，BP140/70mmHg，皮肤微潮，手有细颤，轻微突眼，甲状腺Ⅰ度弥漫性肿大，质软，无触痛。明确诊断的主要检查是
A. 甲状腺放射性核素扫描
B. 垂体功能测定
C. 血甲状腺素水平测定
D. 口服葡萄糖耐量试验
E. 甲状腺摄碘131率

正确答案：C。血甲状腺素水平测定

解析：青年女性患者（Graves病好发人群）；怕热多汗、烦躁易怒、易饿、体重下降、月经稀少（Graves病常见症状）；轻度突眼、手颤、脉压增大（正常为30mmHg～40mmHg）及甲状腺弥漫性肿大、质软、无触痛（Graves病常见体征），最可能的诊断为Graves病。引起甲亢一系列临床表现的关键为血液循环中甲状腺激素过多，作用于全身各系统器官导致其兴奋性增高和代谢亢进，因此其诊断首选血甲状腺素水平测定（C对）。甲状腺放射性核素扫描（A错）主要用于甲状腺高功能腺瘤的诊断。垂体功能测定（B错）主要用于垂体性甲状腺功能亢进的诊断。口服葡萄糖耐量（D错）试验主要用于糖尿病的诊断（P732）。甲状腺摄¹³¹碘率（E错）现已被sTSH（敏感TSH）测定技术所代替，临床上少用。